关于现况研究优点描述正确的是
A. 调查时可以同时观察多种因素
B. 可以确定因果的时相关系
C. 可以检验疾病的病因
D. 样本估计总体的可信度不高
E. 不存在生存者偏倚

正确答案：A。调查时可以同时观察多种因素

解析：本题考查现况研究的优点。现况研究的优点为：①抽样调查的样本一般来自人群，即从一个目标群体中，随机地选择一个代表性样本来进行暴露与患病状况的描述研究，以样本估计总体的可信度较高；②现况研究是在资料收集完成之后，将样本按是否患病或是否暴露来分组比较的，使结果具有可比性；③现况研究往往采用问卷调查或实验室检测等手段收集研究资料，故一次调查可同时观察多种因素（A对BCDE错）。